患者，女，20岁，未婚。每于经期鼻衄，量多、色深红，心烦易怒，口苦咽干，尿黄便结。近3个月来，月经提前7天，量少、色红，舌红苔黄，脉弦数。其诊断是
A. 逆经肺肾阴虚证
B. 月经先期血热证
C. 逆经肝经郁火证
D. 月经先期肝郁化热证
E. 月经过少血虚证

正确答案：C。逆经肝经郁火证

解析：患者经期鼻衄，量多，色红伴月经量少，像月经倒行逆上，故患者所患为逆经，肝气郁结，木火炽盛，冲气偏盛，值经期，冲气夹肝火上逆，热伤阳络，血随气升，故鼻衄，火盛则血量多，色鲜红，肝郁化火，故心烦易怒，热灼津液，故口苦咽干，尿黄便结，舌红苔黄，脉弦数均为肝经郁火之象（C对）。肺肾阴虚，虚火上炎，经行后阴虚更甚，虚火内炽，损伤肺络，故血上溢出现吐衄，出现经前或经期吐衄，色黯红，月经先期，量少，头晕耳鸣。五心烦热等症状（A错）。月经先期为月经周期提前7天以上，甚至10余日一行者，连续两个周期以上者，无经期鼻衄症状（BD错）。月经过少是指月经周期正常，经量明显减少，或经行不足2天，甚至点滴即净者，患者月经周期提前7天连续3月（E错）。